患者，男，48岁。慢性支气管炎急性发作咳嗽气粗，咳痰不爽，胸胁胀满，面赤，舌红苔黄腻，脉滑数有力。其治法是
A. 清热化痰
B. 清肺降气
C. 疏风清热
D. 疏风祛湿
E. 养阴润肺

正确答案：A。清热化痰

解析：患者咳嗽气粗，咳痰不爽，胸胁胀满，面赤，舌红苔黄腻，脉滑数有力，为痰热郁肺证症状，治法为清热化痰，宣肺止咳（A对）。肺热咳喘可用清肺降气法治疗（B错）。风热犯肺证可用疏风清热法（C错）。风毒外侵可用疏风祛湿法治疗（D错）。肺肾阴虚咳喘可用养阴润肺法治疗（E错）。